属于内痔截石位的好发部位
A. 6、9、12点
B. 3、6、9点
C. 3、7、11点
D. 12点
E. 1、5、9点

正确答案：C。3、7、11点

解析：内痔的主要临床表现是出血和脱出。间歇性便后出鲜血是内痔的常见症状。未发生血栓、嵌顿、感染时内痔无疼痛，部分病人可伴发排便困难。内痔的好发部位为截石位3、7、11钟点位（C对）。